可出现嗜酸性粒细胞减少的疾病是
A. 支气管哮喘
B. 伤寒
C. 荨麻疹
D. 钩虫病
E. 慢性粒细胞白血病

正确答案：B。伤寒

解析：嗜酸粒细胞减少见于伤寒、副伤寒、应激状态（如严重烧伤、急性传染病的极期）、休克、库欣综合征等（B对）。支气管哮喘多见嗜酸性粒细胞增多（A错）。荨麻疹多见淋巴细胞增多（C错）。钩虫病多见嗜酸性粒细胞增多（D错）。慢性粒细胞白血病多见嗜酸性粒细胞增多（E错）。